酮体包括
A. 草酰乙酸、β-羟丁酸、丙酮
B. 乙酰乙酸、β-羟丁酸、丙酮酸
C. 乙酰乙酸、γ-羟丁酸、丙酮
D. 乙酰乙酸、β-羟丁酸、丙酮
E. 乙酰丙酸、β-羟丁酸、丙酮

正确答案：D。乙酰乙酸、β-羟丁酸、丙酮